松牙固定术的时机不包括
A. 外伤松动牙
B. 牙周手术前固定患牙
C. 牙周手术后固定患牙
D. 基础治疗前固定患牙
E. 牙周病治疗的修复阶段

正确答案：D。基础治疗前固定患牙

解析：本题考查松牙固定的指征和时机。松牙固定术的时机和指征：松牙固定术应在经过牙周基础治疗后完成（D错，为本题正确答案）；因外伤而松动的牙，用夹板固定后，有利于牙周组织的修复（A对）；在手术前完成松牙固定术，可减轻术中的创伤，有利于术后组织的修复（B对）。牙周炎松动牙经牙周手术治疗后，牙松动仍较明显，可作松牙固定术以利于牙周组织的修复再生（C对）。牙周病治疗的修复阶段固定患牙，有利于牙周组织的修复（E对）。